在脾胃的关系中，最根本的是
A. 脾燥胃湿，燥湿相济
B. 太阴湿土得阳始运，阳明燥土得阴自安
C. 胃主纳谷，脾主磨谷
D. 脾主升清，胃主降浊
E. 胃为水谷之海，脾为胃行其津液

正确答案：D。脾主升清，胃主降浊

解析：脾胃居于中焦，脾气主升而胃气主降，相反而相成；脾气上升，将运化吸收的水谷精微向上输布，有助于胃气之通降；胃气通降，将受纳之水谷、食糜通降下行，也有助于脾气之升运。一升一降，相互为用，为气机升降之枢，这是其最根本的关系（D对）。